下列药物能够起到选择性延长复极的药物是
A. 胺碘酮
B. 普萘洛尔
C. 维拉帕米
D. 地尔硫（艹卓）
E. 利多卡因

正确答案：A。胺碘酮

解析：Ⅲ类——选择性延长复极的药物：抑制多种钾电流，延长APD和ERP，对动作电位幅度和去极化速率影响小。本类药有胺碘酮等。掌握“抗心律失常药”知识点。